腰椎间盘突出症体征错误的是
A. 腰椎侧突具有辅助诊断价值
B. 几乎全部患者有不同程度的腰部活动受限
C. 大多数患者在病变间隙的棘突间有压痛
D. 大多数患者有肌力下降
E. 直腿抬高试验及加强试验多为阴性

正确答案：E。直腿抬高试验及加强试验多为阴性

解析：腰椎间盘突出症病人由于神经根受压或粘连使滑动度减少或消失，抬高在60°以内即可出现坐骨神经痛，称为直腿抬高试验阳性。在直腿抬高试验阳性时，缓慢降低患肢高度，待放射痛消失，再被动背曲踝关节以牵拉坐骨神经，如又出现放射痛，称为加强试验阳性（E错，为本题正确答案）。腰椎侧突是一种为减轻疼痛的姿势性代偿畸形，具有辅助诊断作用（A对）。几乎全部患者有不同程度的腰部活动受限（B对），且大多数患者在病变间隙的棘突间有压痛（C对）。由于神经受压，时间较长可有肌力的下降（D对）。